女，50岁，因患短肠综合症，予全胃肠外营养（TPN）治疗。应用一周时病人出现昏迷，但尿内无酮体。病人既往曾有空腹血糖高（11mmol/L）。此病的预防主要是
A. 开始一周内注意葡萄糖输注的浓度速度和与胰岛素的比例
B. 加强保肝
C. 加强导管护理、无菌操作
D. 纠正水和电解质紊乱，预防酸中毒发生
E. 保护肾功能

正确答案：A。开始一周内注意葡萄糖输注的浓度速度和与胰岛素的比例

解析：该患者既往曾有空腹血糖高（11mmol／L），可诊断为糖尿病。该患者突然昏迷、尿酮阴性，应考虑高渗高血糖综合征导致的昏迷，即高渗性非酮性昏迷。其发病机制是：糖尿病患者内源性胰岛素分泌不足，不能适应肠外营养的相对高渗溶液，导致血糖过高而引发组织高渗性脱水和进行性意识障碍。因此，此病的预防主要是开始一周内注意葡萄糖输注的浓度速度和与胰岛素的比例（A对），避免血糖过高。